作用于花生四烯酸环氧酶的药物有
A. 吲哚美辛
B. 对乙酰氨基酚
C. 双氯芬酸钠
D. 醋酸氢化可的松
E. 醋酸地塞米松

正确答案：A、B、C。吲哚美辛；对乙酰氨基酚；双氯芬酸钠

解析：本题考查作用于花生四烯酸环氧酶的药物。非甾体抗炎药吲哚美辛（A对）、对乙酰氨基酚（B对）、双氯芬酸钠（C对）都作用于花生四烯酸环氧酶；醋酸氢化可的松（D错）、醋酸地塞米松（E错）均为肾上腺糖皮质激素，不作用于花生四烯酸环氧酶。